男，25岁。发作性意识丧失伴四肢抽搐8年。2天前自行调整治疗药物，次日出现频繁发作，意识不清。应立即采取的处理措施是
A. 鼻饲苯妥英钠
B. 口服丙戊酸钠
C. 静脉注射地西泮
D. 肌注苯巴比妥
E. 气管切开

正确答案：C。静脉注射地西泮

解析：青年男性患者，发作性意识丧失伴四肢抽搐8年（根据临床症状可诊断为癫痫）。2天前自行调整治疗药物（癫痫持续状态的诱因），次日出现频繁发作，意识不清（出现癫痫持续状态）。癫痫持续状态时应尽快终止持续状态的癫痫发作，以减少对脑神经元的损害，癫痫持续发作首选静脉注射地西泮（C对）。苯妥英钠（A错）对GTCS（全面强直-痉挛发作）和部分性发作有效，胃肠道吸收慢。丙戊酸钠（B错）是全面性发作，尤其是GTCS合并典型失神发作的首选药。苯巴比妥（D错）是小儿癫痫的首选药。